记录患者提供的药名、诊断和手术名称需加引号（“”）以示区别应为
A. 发病情况
B. 伴随症状
C. 发病以来诊治经过及结果
D. 发病以来一般情况
E. 主要症状特点及其发展变化情况

正确答案：C。发病以来诊治经过及结果

解析：发病以来诊治经过及结果：记录患者发病后到入院前，在院内、外接受检查与治疗的详细经过及效果。对患者提供的药名、诊断和手术名称需加引号（“”）以示区别。掌握“口外病史记录”知识点。